急危重患者在抢救中的道德要求不包括
A. 要争分夺秒，积极抢救病人
B. 要满腔热忱，重视心理治疗
C. 不承担风险，凡事必须患者或患者家属知情同意
D. 全面考虑，维护社会公益
E. 要加强业务学习，提高抢救成功率

正确答案：C。不承担风险，凡事必须患者或患者家属知情同意